女，35岁。与家人吵架后服敌百虫100ml，30分钟后被急送医院。查体：昏迷状态，呼吸困难，皮肤湿冷，双瞳孔如针尖大小。正确的紧急处理是
A. 气管插管气道保护后硫酸铜溶液洗胃+导泻
B. 直接应用大量生理盐水洗胃+导泻
C. 直接应用硫酸铜溶液洗胃+导泻
D. 气管插管气道保护后2%碳酸氢钠溶液洗胃
E. 气管插管气道保护后应用大量温水洗胃+导泻

正确答案：E。气管插管气道保护后应用大量温水洗胃+导泻

解析：患者青年女性，服用敌百虫农药而出现中毒症状，查体：昏迷状态，呼吸困难，皮肤湿冷，双瞳孔如针尖大小，提示已经出现毒蕈碱样症状和中枢神经系统症状，此时应立即行气管插管气道保护，保持呼吸道通畅（BC错），并用大量温水洗胃，直至洗出液清亮为止，洗胃后，灌入泻药以清除肠道内毒物。综上所诉，正确的紧急处理是气管插管气道保护后应用大量温水洗胃+导泻（E对）。硫酸铜溶液洗胃常用于磷中毒，敌百虫中毒时洗胃液多为温开水和盐水（A错）。敌百虫中毒时严禁使用2%碳酸氢钠溶液洗胃，因碱性溶液能使敌百虫转变为毒性更强的敌敌畏（D错）。